王不留行与穿山甲均有的功效是
A. 活血，下乳
B. 活血，生肌
C. 活血，凉血
D. 活血，舒筋
E. 活血，行气

正确答案：A。活血，下乳

解析：本题考查王不留行与穿山甲的功效。王不留行与穿山甲均有的功效是活血，下乳（A对）。穿山甲、王不留行，均能活血通经、下乳，同治血滞闭经、痛经、产后瘀阻腹痛，以及乳痛、乳汁短少或不下等证。王不留行【功效】活血通经，下乳消肿，利尿通淋。穿山甲【功效】活血消癥，通经下乳，消肿排脓。乳香【功效】活血止痛，消肿生肌（B错）。紫草【功效】凉血活血（C错），解毒透疹。鸡血藤【功效】活血补血，调经止痛，舒筋（D错）活络。川芎【功效】活血行气（E错），祛风止痛。